小儿生长发育最迅速的时期，身长在一年中增长50%，体重增加2倍，是哪一发展阶段的特点
A. 婴儿期
B. 胎儿期
C. 围产期
D. 幼儿期
E. 新生儿期

正确答案：A。婴儿期

解析：婴儿期又称为乳儿期，出生后至满1周岁之前，新生儿期包括在内。特点：①是小儿生长发育最迅速的时期，身长在一年中增长50%，体重增加2倍。掌握“小儿年龄分期”知识点。